皮瓣的组成是
A. 表皮+真皮全层
B. 表皮+真皮+皮下组织+肌
C. 表皮+真皮+皮下组织
D. 表皮+真皮乳头
E. 表皮+真皮+皮下组织+肌+骨

正确答案：C。表皮+真皮+皮下组织

解析：本题考查皮瓣的组成。皮瓣的组成是表皮+真皮+皮下组织（C对）。皮瓣是由表皮、真皮以及皮下组织构成的。表皮及真皮全层（A错）构成全厚皮片。表皮+真皮+皮下组织+肌（B错）是肌皮瓣。真皮层分为乳头层和网织层，表皮及真皮乳头层（D错）构成中厚皮片。表皮+真皮+皮下组织+肌+骨（E错）是带蒂骨肌瓣。